长期、多数后牙缺失，且久未修复，咬合关系紊乱最易造成
A. 美观的影响
B. 咀嚼功能减退
C. 发音功能障碍
D. 颞下颌关节病变
E. 对牙周组织的影响

正确答案：D。颞下颌关节病变

解析：颞下颌关节病变：长期、多数后牙缺失，且久未修复，有可能造成颞下颌关节的病变。其主要原因是干扰引起的咬合关系紊乱，一侧丧失咬合后出现的咀嚼肌张力不平衡；双侧后牙咬合关系丧失后，垂直距离减少致髁突后上移位，盘突关系异常造成关节症状等。掌握“牙列缺损病因及影响”知识点。